线粒体内膜两侧形成质子梯度的能量来源是
A. 磷酸肌酸水解
B. ATP水解
C. 磷酸烯醇式丙酮酸
D. 电子传递链在传递电子时所释放的能量
E. 各种三磷酸核苷酸

正确答案：D。电子传递链在传递电子时所释放的能量